女，50岁。入睡困难、多梦易醒1个月，每周至少3次。同时感到精力疲乏，工作效率下降，对睡眠产生恐惧感，担心免疫力下降，否认情绪低落和消极观念。对该患者应选择的心理干预是
A. 催眠疗法
B. 认知行为疗法
C. 系统脱敏法
D. 森田疗法
E. 行为塑造

正确答案：B。认知行为疗法

解析：该患者1个月来，每周至少3次，以入睡困难、多梦易醒为主要表现，同时感到精力疲乏，工作效率下降，引起恐惧感，否认情绪低落和消极观念（排除抑郁症），故诊断为失眠障碍，应选择专门针对失眠的认知行为治疗（B对）。催眠疗法（A错）是运用暗示的方法使病人进入一种特殊的意识状态，从而解除和治疗病人的心身问题的心理疗法，常用来治疗抑郁症，焦虑症和恐惧症等。系统脱敏疗法（C错）主要是诱导求治者缓慢地暴露出导致神经症焦虑、恐惧的情境，并通过心理的放松状态来对抗这种焦虑情绪，从而达到消除焦虑或恐惧的目的，用于治疗各种焦虑症、恐惧症以及创伤后应激障碍病人。森田疗法（D错）的治疗原则是“任其自然地接受情绪，把应该做的事作为真正的目的和行动的准则”。即所谓的“顺其自然”，适应证包括强迫症、疑病性神经症、焦虑性神经症和自主神经功能紊乱。行为塑造（E错）是一项通过强化而产生某种期望的良好行为的治疗技术，适用于恐惧症、多动症、神经性厌食症、肥胖症、物质依赖和酒依赖等疾病的矫治。也可用于孤独症儿童和精神发育不全儿童的行为问题的矫治。